引起水体藻类污染出现水体富营养化的主要原因是
A. 大量含氮、硫、磷的有机物污染水体
B. 大量含钠、钾的污染物污染水体
C. 大量含氮、磷的污染物污染水体
D. 大量含氨、钠的污水进入水体
E. 大量含氨、磷的污染物进入水体

正确答案：C。大量含氮、磷的污染物污染水体

解析：本题考查引起水体藻类污染出现水体富营养化的主要原因。引起水体藻类污染出现水体富营养化的主要原因是大量含氮、磷的污染物污染水体（C对ABDE错）。